生物体内的抗氧化酶类不包括
A. 超氧化物歧化酶
B. 过氧化氢酶
C. 谷胱甘肽过氧化物酶
D. 谷胱甘肽硫转移酶
E. NADH氧化酶

正确答案：E。NADH氧化酶

解析：生物体内的抗氧化酶类包括超氧化物歧化酶(SOD)（A对）可歧化O2-生成H202, 过氧化氢酶（B对）可清除H202,谷胱甘肤过氧化物酶(GSHP- x)（C对）可清除OH· 。NADH可通过NADH氧化酶（E错，为本题正确答案）促反应产生自由基。